关于毒物兴奋性剂量-反应关系曲线说法正确的是
A. 在低剂量表现为适当的刺激反应，而在高剂量条件下表现为抑制作用。
B. 在低剂量表现为适当的抑制反应，而在高剂量条件下也表现为抑制作用。
C. 在低剂量表现为适当的刺激反应，而在高剂量条件下也表现为刺激作用。
D. 在低剂量表现为适当的抑制反应，而在高剂量条件下表现为刺激作用。

正确答案：A。在低剂量表现为适当的刺激反应，而在高剂量条件下表现为抑制作用。

解析：本题考查毒物兴奋性剂量-反应关系曲线。毒物兴奋性剂量-反应关系曲线在低剂量条件下表现为适当的刺激反应，而在较高或高剂量条件下表现为抑制作用（A对BCD错）。